以下与类天疱疮有关的说法哪项是错误的
A. 有自身循环抗体
B. 有抗基底膜抗体
C. 有抗细胞间抗体
D. 可用直接免疫荧光检查
E. 抗基底膜区抗体主要是IgG

正确答案：C。有抗细胞间抗体

解析：本题考查类天疱疮。抗细胞间抗体（C错，为本题的正确答案）可在天疱疮中被检测出来。类天疱疮是一类在临床上以黏膜皮肤的厚壁张力性大疱为特征的疾病，目前认为本病属自身免疫性疾病，可用直接免疫荧光检查（D对）出抗基底膜区抗体主要是IgG（E对），间接免疫荧光检查可见少数患者有抗基底膜抗体（B对）即自身循环抗体（A对）。